为了提高某筛检试验的阳性预测值，可采取
A. 增加筛检的次数
B. 减少筛检的次数
C. 选择高危人群
D. 对筛检阳性者进行更仔细的诊断
E. 与其它试验方法联合使用

正确答案：C。选择高危人群

解析：本题考查阳性预测值。为了提高某筛检试验的阳性预测值，可采取选择高危人群（C对ABDE错），阳性预测值是筛检发现的阳性者中患目标疾病的人所占的比例，若想发现更多的目标疾病人群，可在高危人群中进行筛检，这样就有更大的几率筛检出患目标疾病的人。